治疗热哮发作期，应首选
A. 桑白皮汤
B. 麻杏石甘汤
C. 苏子降气汤
D. 定喘汤
E. 泻白散

正确答案：D。定喘汤

解析：热哮证的病机是痰热蕴肺，壅塞气道，肺失清肃，治疗应清痰热，恢复肺的宣发肃降之功，治法采用清热宣肺，化痰定喘，首选宣降肺气，清热化痰的定喘汤（D对）。桑白皮汤功能清热肃肺化痰，用于治疗喘证痰热郁肺证或肺脏痰热郁肺证（A错）。麻杏石甘汤功能宣肺泄热、降气平喘，为喘证表寒肺热证的选方（B错）。苏子降气汤功能降气平喘，祛痰止咳，主治上实下虚喘咳证（C错）。泻白散功能顺气降火，清肺化痰，常合黛蛤散治疗咳嗽肝火犯肺证（E错）。